与药物剂量无关的中药不良反应
A. 由药物本身或其代谢物所引起
B. 与药物固有的正常药理作用无关
C. 常由中药配伍发生相互作用引起
D. 常与药物依赖性和成瘾性有关
E. 与疾病引起的器质性改变无明显区别

正确答案：B。与药物固有的正常药理作用无关

解析：本题考查的是药物不良反应的病因学分类。与药物剂量无关的中药不良反应（B对）。中药药物不良反应的病因学分类：（1）与药物剂量有关的中药不良反应：该类型由药物本身或其代谢物所引起（A错），使固有药理作用持续和增强。由于不同个体在药物吸收、分布、代谢及排泄等方面的差异，导致单位时间内药物浓度异常升高，引起有关组织器官的不良反应。其不良反应包括药物的副作用、毒性作用，以及继发反应、首剂效应、后遗作用等。该类型具有剂量依赖性和可预测性，个体易感性差异大，并受年龄、性别、病理状态等因素影响，一旦发生，后果十分严重，甚至可导致死亡。（2）与药物剂量无关的中药不良反应：该类型与药物固有的正常药理作用无关，而与药物变性（如药物有效成分降解产生有害物质）和人体特异体质（指患者的特殊遗传素质）有关。该类型与用药剂量无关，难以预测，经常规的毒理学筛选也很难发现，发生率虽较低，但危险性大，病死率较高。中药配伍发生相互作用常引起（C错）药效、毒性变化的关系称为七情。七情是单行、相使、相须、相畏、相杀、相恶、相反的合称，用以说明中药配伍后药效，毒性变化的关系。药物依赖性和成瘾性（D错）为中药药物不良反应/事件的发生机制之一。药物依赖性：药物依赖性的发生机制可分为精神依赖性和生理依赖性。如部分患者长期服用番泻叶可产生生理依赖性，主要症状包括焦虑不安、全身疼痛、失眠、面热潮红、厌食、体温上升、呼吸频率加快、心率加快、呕吐、腹痛等。连续服用罂粟壳及含有罂粟壳的中成药易致成瘾，出现的症状兼有生理依赖性和精神依赖性。与疾病引起的器质性改变无明显区别（E错）的是药物不良反应引起的器质性改变。器质性改变：系指药物引起人体器官或组织出现病理性器质改变。由于药物不良反应引起的器质性改变，与疾病本身引起器质性改变无明显区别，因此鉴别诊断时不能仅根据组织病理检查，还应参照药物不良反应判断。此类型又可细分为炎症型、增生型、发育不全型、萎缩坏死型等。